Th1细胞通过产生IFN-γ，激活巨噬细胞杀伤胞内寄生菌是
A. 清除胞内寄生菌
B. 清除结核杆菌
C. 清除布氏杆菌
D. 清除麻风杆菌
E. 以上说法均正确

正确答案：E。以上说法均正确

解析：Th1细胞通过产生IFN-γ，激活巨噬细胞杀伤胞内寄生菌，这是清除胞内寄生菌如结核杆菌、布氏杆菌和麻风杆菌的主要方式。掌握“B细胞、T细胞介导的免疫应答”知识点。